以下器官抗原在正常状态下不进入血液和淋巴液的是
A. 肌肉
B. 心脏
C. 肝脏
D. 肾脏
E. 胆囊

正确答案：B。心脏

解析：与免疫系统相对隔绝部位的抗原如脑、睾丸、眼球、心肌和子宫抗原在正常状态下不进入血液循环和淋巴液。掌握“常见口腔自身免疫性疾病及自身免疫性疾病的治疗”知识点。